第Ⅰ相生物转化代谢中发生的反应是
A. 氧化反应
B. 重排反应
C. 卤代反应
D. 甲基化反应
E. 乙基化反应

正确答案：A。氧化反应

解析：本题考查生物转化。药物的生物转化通常分为二相：第Ⅰ相生物转化是指体内各种酶对药物分子进行的官能团化反应，主要发生在分子的官能团上，包括氧化（A对）、还原、水解、羟基化等反应，不包括重排反应（B错）和乙基化反应（E错）。含卤素的药物发生脱卤的反应为水解反应（C错）。甲基化（D错）发生在第Ⅱ相生物转化反应中。